患者，男，32岁。恶寒发热2天，伴咽喉肿痛，口渴，舌苔薄黄。治疗除取主穴外，还应选用的穴位是
A. 风门、肺俞
B. 外关、身柱
C. 曲池、中府
D. 阴陵泉、委中、中冲
E. 曲池、尺泽、鱼际

正确答案：E。曲池、尺泽、鱼际

解析：该患者恶寒发热2天为主症，故诊断为感冒。咽喉肿痛，口渴，舌苔薄黄为风热之邪犯表之象，故诊断为风热感冒。风门、肺俞为风寒感冒的配穴（A错）。外关、身柱用于治疗感冒全身酸楚（B错）。曲池、中府用于治疗风热咳嗽（C错）。阴陵泉、委中、中冲用于暑湿感冒（D错）。曲池、尺泽为风热感冒的配穴，鱼际能治疗咳嗽、咽干、咽喉肿痛等肺系热性病（E对）。